六淫邪气中最易伤肺的是
A. 风
B. 寒
C. 暑
D. 燥
E. 火

正确答案：D。燥

解析：肺为娇脏，喜润恶燥，燥邪多自口鼻而入，易损伤肺津，进而会影响到肺气的宣发肃降（D对）。风（A错）邪的性质和致病特征：风性轻扬开泄，易袭阳位；善行数变；风性主动；风为百病之长。寒（B错）邪的性质和致病特点：寒为阴邪，易伤阳气；寒性凝滞；寒性收引。暑（C错）邪的性质和致病特点：暑为阳邪，其性炙热；暑性升散，易扰心神，易伤津耗气；暑多夹湿。火（热）邪（E错）的性质和致病特点：火热为阳邪，其性燔灼趋上；火热易扰心神；火热易伤津耗气；火热易生风动血；火邪易致阳性疮痈。